某男，70岁。冠心病史7年。常感胸痛隐隐，神疲乏力，气短懒言，心悸自汗，舌淡暗苔白，脉弱。根据辨证结果，应采取的治法是
A. 温阳散寒
B. 益气活血
C. 豁痰化瘀
D. 益气养阴
E. 温补心肾

正确答案：B。益气活血

解析：本题考查的是胸痹的辨证论治。冠心病史7年。常感胸痛隐隐，神疲乏力，气短懒言，心悸自汗，舌淡暗苔白，脉弱。根据辨证结果，应采取的治法是益气活血（B对）。胸痹是指以胸部闷痛，甚则胸痛彻背，短气、喘息不得卧为主症的疾病，轻者仅感胸闷如窒，呼吸欠畅，重者则有胸痛，严重者心痛彻背，背痛彻心。西医学的冠心病（心绞痛或心肌梗死）、其他原因引起的心绞痛（如主动脉瓣狭窄、梗阻性肥厚型心肌病）、心包炎以及肺源性心脏病等以上述表现为主者，可参考此内容辨证论治。（一）气虚血瘀证：【症状】胸痛隐隐，遇劳则发，神疲乏力，气短懒言，心悸自汗。舌胖有齿痕，色淡暗，苔薄白，脉弱而涩，或结、代。【治法】益气活血，通脉止痛。（二）气滞血瘀证：【症状】心胸疼痛，如刺如绞，痛有定处，入夜为甚，重者心痛彻背，背痛彻心，或痛引肩背，伴有胸闷，日久不愈，可因暴怒、劳累而加重。舌质紫暗，有瘀斑，苔薄，脉弦细。【治法】理气活血，通脉止痛。（三）痰浊痹阻证：【症状】胸闷重而心痛微，痰多气短，肢体沉重，形体肥胖，遇阴雨天而易发作或加重，伴有倦怠乏力，纳呆便溏，咳吐痰涎。舌体胖大且边有齿痕，苔浊腻或白滑，脉滑。【治法】通阳泄浊，豁痰宣痹。（四）寒凝心脉证：【症状】猝然心痛如绞，心痛彻背，喘不得卧，多因气候骤冷或骤感风寒而发病或加重，伴形寒，甚则手足不温，冷汗自出，胸闷气短，心悸，面色苍白。舌质紫暗，或有瘀斑瘀点，苔薄，脉沉紧或沉细。【治法】辛温散寒，宣通心阳。（五）气阴两虚证：【症状】胸闷隐痛，时作时止，心悸气短，动则益甚，伴倦怠懒言，易汗出，头晕，失眠多梦。舌红或淡红，舌体胖且边有齿痕，苔薄白或少，脉细缓或结代。【治法】益气养阴（D错），活血通脉。治法为温阳散寒（A错）、豁痰化瘀（C错）或温补心肾（E错）的病证，2022年考试指南未明确说明。